男性，40岁。中上腹饥饿性隐痛反复发作10年，伴反酸嗳气，进食和服用抑酸剂可缓解。患者4小时前突然出现中上腹剧痛且腹痛持续存在，该患者可能发生的并发症是
A. 急性胰腺炎并发出血坏死
B. 胰腺癌并发肠梗阻
C. 胃癌并发幽门梗阻
D. 消化性溃疡并发急性穿孔
E. 急性胆囊炎并发胆汁性腹膜炎

正确答案：D。消化性溃疡并发急性穿孔

解析：中青年男性患者，反复发作饥饿性上腹痛（饥饿痛为十二指肠溃疡的特征性表现）10年，服用抗酸剂可缓解，可诊断为消化性溃疡（十二指肠溃疡），其并发症有出血、穿孔、幽门梗阻和癌变。该患者突发中上腹剧痛，持续存在，考虑患者消化性溃疡并发急性穿孔（D对）。消化性溃疡并发急性穿孔时，溃疡溃破入腹腔引起弥漫性腹膜炎，呈突发剧烈腹痛，持续而加剧，先出现于上腹，继之延及全腹。